血管疾病时伴发的精神障碍主要表现为
A. 幻觉
B. 妄想
C. 抑郁
D. 焦虑、紧张
E. 思维迟钝

正确答案：D。焦虑、紧张

解析：血管疾病时伴发的精神障碍临床表现：（1）焦虑、紧张：最多见（D对）；（2）幻觉妄想状态：在血液循环障碍严重时偶可出现幻听，常为议论性和命令性。妄想多为被害性；（3）意识障碍：有失神、晕厥发作，症状出现前常先有心前区轻度疼痛，后无力、恶心，继而出现黑蒙、短暂的意识丧失。常见于心绞痛、心律失常和心肌梗死时；（4）抑郁状态。血管疾病伴发的精神障碍可出现幻觉、妄想、抑郁，但均不是主要表现（ABC错）。